呋喃苯胺酸属于下列哪类利尿药
A. 强效利尿药
B. 中效利尿药
C. 保钾利尿药
D. 碳酸酐酶抑制药
E. 渗透性利尿药

正确答案：A。强效利尿药

解析：本题考查呋喃苯胺酸。呋喃苯胺酸属于强效利尿药（A对）。呋喃苯胺酸又名呋塞米，为高效利尿药，主要作用部位在髓袢升支粗段，干扰Na⁺-K⁺-2Cl⁻共同转运系统，产生强大的利尿作用。利尿药分类：1.袢利尿药（高效能利尿药），如呋塞米、依他尼酸等。2.噻嗪类与类噻嗪类利尿药（中效能利尿药）（B错），如氢氯噻嗪、吲达帕胺等。3.保钾利尿药（C错）（低效能利尿药），如螺内酯、氨苯蝶啶等。4.碳酸酐酶抑制药（D错），如乙酰唑胺等。5.渗透性利尿药（E错）（又称脱水药），如甘露醇、山梨醇等。